以下腧穴中，胆的募穴是
A. 胆俞
B. 阳陵泉
C. 章门
D. 期门
E. 日月

正确答案：E。日月

解析：胆的募穴为日月（E对）。胆俞为胆的背俞穴（A错）。阳陵泉为胆的下合穴（B错）。章门为脾的募穴（C错）。期门为肝的募穴（D错）。